体格检査的伦理要求是
A. 平等相待，廉洁奉公
B. 积极进取，保证安全
C. 精诚团结，密切协作
D. 耐心倾听，正确引导
E. 关心体贴，减少痛苦

正确答案：E。关心体贴，减少痛苦

解析：体格检查的伦理要求：全面系统，认真细致；关心体贴，减少痛苦；尊重患者，心正无私（E对）。